男性，68岁，饮酒后不能自行排尿5小时急诊住院，体检见耻骨上包块，有轻压痛。要确诊病因，最简便的影像学检查是
A. CT
B. MRI
C. B超
D. KUB
E. 膀胱造影检查

正确答案：C。B超

解析：老年男性患者，饮酒后不能自行排尿，体检见耻骨上包块，有轻压痛，考虑可能为急性尿潴留。患者为老年男性，有饮酒史，故该患者最可能的病因是前列腺增生。前列腺增生是老年男性排尿障碍原因中最为常见，饮酒可使前列腺突然充血、水肿，使其梗阻症状加重。。为明确病因，最简便的影像学检查是B超（C对），B超可清晰显示前列腺体积大小，增生腺体是否突入膀胱，还可以测定膀胱残余尿量。CT（A错）、MRI（B错）主要用于泌尿系肿瘤的排除诊断。KUB（D错）、膀胱造影检查（E错）对前列腺增生的诊断价值不大。